关于精神分裂症的临床特点，错误的是
A. 多数在青壮年发病
B. 自知力丧失
C. 联想障碍，妄想幻觉是重要的早期表现
D. 偏执型是最常见类型
E. 病程多迁延，预后不佳

正确答案：C。联想障碍，妄想幻觉是重要的早期表现

解析：联想障碍、妄想、幻觉均为精神分裂症阳性症状中的显症期症状，而不是早期表现（C错，为本题正确答案）。目前精神分裂症为一组病因未明的精神病，多起病于青壮年（A对），常有感知、思维、情感、行为等多方面的障碍和精神活动的不协调，一般无意识障碍和明显的智能障碍，病程多迁延，预后不佳（E对）。一般精神分裂症患者缺乏自知力（B对）。精神分裂症以偏执型最为常见（D对）。